下列哪项脾虚泄泻的特点错误
A. 食后作泻，时泻时止
B. 久泻不愈
C. 肌肉消瘦
D. 面色红润
E. 神疲倦怠

正确答案：D。面色红润

解析：面色红润为正常人的面色特点（D错，为本题正确答案）。脾虚泻证候：脾虚运化无力，水谷不化故见大便稀溏，色淡不臭，多于食后作泻，时泻时止（A对），腹胀纳呆，久泻不愈（B对）；脾失健运，气血不足，颜面、肌肉失于充养故见面色萎黄，肌肉消瘦（C对）；气虚推动乏力故见神疲倦怠（E对）；脾气虚弱故见舌淡苔白，脉缓弱，指纹淡。治法：健脾益气，助运止泻。方药：参苓白术散加减。